氯丙嗪治疗精神分裂症时最常见的不良反应是
A. 体位性低血压（直立性低血压）
B. 过敏反应
C. 内分泌障碍
D. 锥体外系反应
E. 消化系统症状

正确答案：D。锥体外系反应

解析：精神分裂症的患者需要长期应用氯丙嗪，所以对于长期大量服用的氯丙嗪可以阻断黑质-纹状体通路的多巴胺受体，造成了锥体外系反应，具体表现为三个方面：①帕金森综合症：表现为肌张力增高、面容呆板、动作迟缓、肌肉震颤、流涎等；②静坐不能：坐立不安、反复徘徊；③急性肌张力障碍：出现在用药后第一天至第五天，舌、面、颈及背部肌肉痉挛造成强迫性张口、伸舌、斜颈呼吸运动障碍及吞咽困难。掌握“氯丙嗪”知识点。